男，36岁。2周前发现右下后牙牙龈有小包，平时无明显不适。检查见右下第一磨牙咬合面深龋，穿髓孔探无感觉，叩（±），右下第二磨牙根尖处牙龈有瘘管开口，压挤少许脓液出。X线片见右下第一磨牙近中根尖X线透射区不规则，边界模糊。主诉牙应诊断为慢性牙槽脓肿，为确诊牙龈瘘管的病牙，应作瘘管诊断丝X线片，主诉牙的治疗是
A. 充填治疗
B. 塑化治疗
C. 根管治疗
D. 根尖手术
E. 拔除

正确答案：C。根管治疗

解析：本题考查慢性根尖周炎的治疗。根据病例描述，主诉牙为慢性根尖周炎，则应该进行根管治疗（C对），清除根管内感染物质，严密充填根管。充填治疗（A错）主要用于龋病的治疗。塑化治疗（B错）是用两型塑化液剂混合发生聚合反应，将根管内的炎性物质包裹起来使牙髓与根管壁整个隔开阻断了刺激，可以用于慢性根尖周炎的治疗，但是它们的效果不如根管治疗好，且因未去除根管内感染牙髓，一段时间后根尖发生感染的风险较高，后续处理困难，在临床上已极少使用。根尖手术（D错）主要包括根尖刮治术、组织活检、根尖切除术和根尖倒充填，主诉牙位慢性根尖周炎，不需要进行根尖手术。拔除（E错）适用于没有保留价值的牙，主诉牙牙周状况良好，不能拔除，应予保留。